某工人从事蓄电池制造工作5年，近来出现头昏、头痛、全身无力、记忆力减退、睡眠障碍、多梦等症状，并出现突发性腹部绞痛，牙齿边缘形成蓝黑色的线。该毒物进入人体最常见的途径是
A. 呼吸道
B. 皮肤
C. 消化道
D. 皮肤和消化道
E. 皮肤和呼吸道

正确答案：A。呼吸道